功血最常见于下列哪种情况
A. 服短效避孕药后
B. 人工流产术后
C. 急性子宫内膜炎
D. 颗粒细胞瘤
E. 卵巢性激素对下丘脑、垂体失去正常反馈作用

正确答案：E。卵巢性激素对下丘脑、垂体失去正常反馈作用

解析：功能性子宫出血，简称功血，是一种常见的妇科疾病，是指异常的子宫出血，经诊查后未发现有全身及生殖器官器质性病变，而是由于神经内分泌系统功能失调所致。表现为月经周期不规律、经量过多、经期延长或不规则出血。根据排卵与否，通常将功血分为无排卵型及排卵型两大类，前者最为多见，约占80～90％，主要发生在青春期及更年期，后者多见于生育期妇女。病因：正常月经周期有赖于中枢神经系统控制，下丘脑－垂体－卵巢性腺轴系统的相互调节及制约。任何内外因素干扰了性腺轴的正常调节，均可导致功血。掌握“功能失调性子宫出血”知识点。